益母草的别名是
A. 通脱木
B. 夜交藤
C. 坤草
D. 皮草
E. 仙灵脾

正确答案：C。坤草

解析：本题考查的是常见的饮片正名与相关别名。益母草的别名是坤草（C对）。益母草别名：坤草、茺蔚、益明。通脱木（A错）为通草的别名。通草别名：通脱木。夜交藤（B错）为首乌藤的别名。首乌藤别名：夜交藤。皮草（D错）为甘草的别名。甘草别名：粉甘草、皮草、国老。仙灵脾（E错）为淫羊藿的别名。淫羊藿别名：仙灵脾。